在颞下颌关节紊乱病中，疼痛有“扳机点”的为
A. 翼外肌功能亢进
B. 翼外肌痉挛
C. 不可复性关节盘前移位
D. 骨关节病
E. 肌筋膜痛

正确答案：E。肌筋膜痛

解析：本题考查颞下颌关节紊乱病。在颞下颌关节紊乱病中，疼痛有“扳机点”的为肌筋膜痛（E对）。肌筋膜痛可有局限性持久性钝痛，有明确的部位和压痛点，压痛点敏感时称之为扳机点，压迫扳机点可引起远处部位的牵涉痛和不适感。翼外肌功能亢进（A错）表现为弹响和开口度过大，无疼痛；翼外肌痉挛（B错）在开口、咀嚼食物时，自觉关节区或关节周围区疼痛；不可复性关节盘前移位（C错）先有可复性关节盘前移位症状，继而弹响消失，开口受限，开口时下颌偏向患侧，关节区疼痛；骨关节病（D错）关节运动时可闻及连续的摩擦音或多声的破碎音，这几种病均不存在扳机点。